具有酚羟基，能溶于氢氧化钠溶液的是
A. 汉防己甲素
B. 延胡索乙素
C. 吗啡
D. 莨菪碱
E. 山莨菪碱

正确答案：C。吗啡